温热病后，神倦瘛疚，舌绛少苔，脉虚弱者治疗应选用
A. 羚角钩藤汤
B. 天麻钩藤饮
C. 地黄饮子
D. 大定风珠
E. 镇肝熄风汤

正确答案：D。大定风珠

解析：温热病之邪，迁延日久，邪热灼伤真阴，或因误汗、妄攻，重伤阴液，致使阴液大亏，肝为风木之脏，阴液大亏，水不涵木，虚风内动，而见手足瘛疭；真阴欲竭，故见神倦乏力、舌绛少苔，脉虚弱，证当属阴虚风动证，治以滋阴息风，方选大定风珠（D对）--方用血肉有情之品鸡子黄、阿胶为君，二药合用，为滋阴熄风的主要配伍。臣以麦冬、生地、白芍滋阴增液，养血柔肝。生龟板、生鳖甲、生牡蛎益阴潜阳，平肝熄风，六者共助君药滋阴熄风之效。佐以麻子仁养阴润燥，五味子酸收，收敛欲脱之阴。甘草调和诸药，与白芍配伍，酸甘化阴。羚角钩藤汤功用为凉肝息风，增液舒筋，主治肝热生风证（A错）。天麻钩藤饮功用为平肝息风，清热活血，补益肝肾，主治肝阳偏亢，肝风上扰证（B错）。地黄饮子功用为滋肾阴、补肾阳、开窍化痰，主治下元虚衰，痰浊上泛之喑痱证（C错）。镇肝息风汤功用为镇肝息风，滋阴潜阳，主治类中风（E错）。